男，29岁，2年前腿部疼痛到医院就诊，被告知怀疑“骨癌”，当时出现不语，行为怪异，摇头晃脑，但逐渐恢复正常，此后骨癌被排除。但患者每遇到不顺心的事，均有类似表现。对该患者最有效的治疗方法是
A. 物理治疗
B. 暗示治疗
C. 抗焦虑药物治疗
D. 行为治疗
E. 抗精神药物治疗

正确答案：B。暗示治疗

解析：分离性神经障碍早期治疗十分重要，无器质性损害，心理社会因素持续存在时，不应强化心理社会因素与症状的关联。暗示治疗分为觉醒时暗示和催眠暗示两种，前者通过解释激发患者对治疗结局产生期望和信心，然后通过语言暗示，或配合适当理疗、针刺或按摩，即可取得良好效果。后者，在患者进入催眠状态下进行暗示治疗（B对）。抑郁症可选择进行物理治疗（A错）。抗焦虑药物临床应用广泛，用于治疗各型神经症、各种失眠以及各种躯体疾病伴随出现的焦虑、紧张、失眠、自主神经系统紊乱等症状，也可用于各类伴焦虑、紧张、恐惧、失眠的精神病 以及激越性抑郁 、轻性抑郁的辅助治疗（C错）。出现人格改变的选择行为治疗，题目中没有出现人格改变（D错）。抗精神病药物主要用于抗精神病和镇静作用，主要不用于分离障碍（E错）。